蚓状肌的作用是对第2—5指
A. 屈手指指骨间关节，伸掌指关节
B. 屈手指指骨间关节，屈掌指关节
C. 屈掌指关节，伸指骨间关节
D. 屈远侧指骨间关节，伸近侧指骨间关节
E. 伸远侧指骨间关节，屈近侧指骨间关节

正确答案：C。屈掌指关节，伸指骨间关节

解析：蚓状肌的作用是收缩时屈第2～5指掌指关节和伸其指骨间关节，即对第2—5指屈掌指关节，伸指骨间关节（C对）。